开髓时，下列哪个牙容易发生髓室底穿通
A. 下颌第一磨牙
B. 上颌第一磨牙
C. 下颌第一前磨牙
D. 上颌第一前磨牙
E. 上颌第二磨牙

正确答案：A。下颌第一磨牙

解析：本题考查恒磨牙髓腔形态及乳恒牙髓腔临床意义。下颌第一磨牙（A对）因髓室顶和髓室底相距较近，开髓时应防止穿通髓室底。